患者，男，22岁。头痛，以后头部为主，阵阵发作，痛如锥刺，时有胀痛，每当受风或劳累时疼痛加重，舌苔薄，脉弦。治疗应首选
A. 后顶、天柱、昆仑、阿是穴
B. 百会、通天、行间、阿是穴
C. 上星、头维、合谷、阿是穴
D. 通天、头维、太冲、阿是穴
E. 头临泣、目窗、前顶、阿是穴

正确答案：A。后顶、天柱、昆仑、阿是穴

解析：本题考查常见的病症的辩证、处方。题中患者头痛阵阵发作、痛如锥刺、劳累时加重，无其他兼证，可辩证为头痛中的风邪袭络证，头痛部位为后头部。治疗后头部头疼的处方为后顶、天柱、昆仑、阿是穴（A对）。治疗颠顶部头疼的处方为百会、通天、行间、阿是穴（B错）。治疗前头部头疼的处方为上星、头维、合谷、阿是穴（C错）。治疗侧头部头痛处方为率谷、太阳、侠溪、阿是穴（DE错）。